假设某疾病只有一个充分病因，而且该充分病因只有两个组分病因A和B，当同时暴露于A和B时，疾病就会发生。再假设某人群中暴露于A的人数占10%，暴露于B的人数占2%，且A和B在该人群中的分布是独立的（即彼此在人群中出现的比例互不影响）。据此，以下论述错误的是
A. 暴露于A的人群的发病率为2%，因为它取决于A的互补组分病因B的暴露率；同理，暴露于B的人群的发病率为10%
B. 同时暴露于A和B的人的发病率为100%，因为同时暴露于A和B时，疾病就会发生
C. 暴露于B但未暴露于A的人群的发病率为0%，因为没有A疾病不会发生；反之亦然
D. 在暴露于某一个组分病因的人群中，发病率的高低与该暴露的互补组分病因有关，互补组分病因越常见，发病率则越高
E. 暴露于B的暴露组与非暴露于B的对照组发病率之差为10%-2%＝8%

正确答案：E。暴露于B的暴露组与非暴露于B的对照组发病率之差为10%-2%＝8%

解析：本题考查充分病因和组分病因以及发病率。题中只是暴露于A和B的人数，由于总人数不知道无法得出发病率，故不能用暴露人数当做发病率相加减（E错，为本题正确答案）。根据题干可知，暴露于A的人群的发病率为2%，因为它取决于A的互补组分病因B的暴露率；同理，暴露于B的人群的发病率为10%（A对）。同时暴露于A和B的人的发病率为100%，因为同时暴露于A和B时，疾病就会发生（B对）。暴露于B但未暴露于A的人群的发病率为0%，因为没有A疾病不会发生；反之亦然（C对）。在暴露于某一个组分病因的人群中，发病率的高低与该暴露的互补组分病因有关，互补组分病因越常见，发病率则越高（D对）。